干扰RNA转录的药物是
A. 环磷酰胺
B. 多柔比星
C. 紫杉醇
D. 甲氨蝶呤
E. 三尖杉碱

正确答案：B。多柔比星

解析：本题考查多柔比星。多柔比星（B对）直接作用于DNA或嵌入DNA，干扰DNA的模板功能，从而干扰转录过程，阻止mRNA的形成。主要适用于急性白血病，对急性淋巴细胞白血病及粒细胞白血病均有效，一般作为第二线药物，即在首选药物耐药时可考虑应用此药。环磷酰胺（A错）通过与细胞中DNA发生共价结合，使其丧失活性或使DNA分子发生断裂，导致肿瘤细胞死亡。紫杉醇（C错）通过作用于处于聚合状态的微管蛋白，妨碍纺锤体的形成，阻止细胞的正常分裂，使细胞停止于G₂/M期。甲氨蝶呤（D错）为抗代谢药及干扰核酸生物合成药，能与体内某些代谢物发生特异性结合，从而影响或拮抗代谢功能。甲氨蝶呤为抗叶酸类抗肿瘤药，主要通过对二氢叶酸还原酶的抑制而阻碍肿瘤细胞DNA的合成，抑制肿瘤细胞的生长与繁殖，选择性地作用于S期。主要适用于急性白血病、乳腺癌、绒毛膜上皮癌及恶性葡萄胎、头颈部肿瘤、骨肿瘤、白血病脑膜脊髓浸润、肺癌、生殖系统肿瘤、肝癌、顽固性普通牛皮癣、系统性红斑狼疮、皮肌炎等自身免疫病。三尖杉碱（E错）能抑制真核细胞内蛋白质的合成，使多聚核糖体解聚，是干扰蛋白质合成功能的抗癌药物。